定喘汤的组成药物中含有
A. 半夏、当归
B. 麻黄，杏仁
C. 桑白皮、地骨皮
D. 黄芩，陈皮
E. 苏子、橘红

正确答案：B。麻黄，杏仁

解析：本题考查定喘汤的药物组成。定喘汤为理气剂，由白果(去壳，砸碎炒黄)、麻黄、半夏(法制，如无，用甘草汤泡七次，去脐用)、款冬花、桑白皮(蜜炙)各9g，苏子、黄芩(微炒)各6g，甘草3g，杏仁(去皮、尖)4.5g组成（B对）。记忆：定喘苏秦骂白桑，冬花夏草—定喘苏芩麻白桑，冬花夏草杏。